传染病的基本特征不包括
A. 有病原体
B. 有传染性
C. 有传染后免疫
D. 有阶段性
E. 有流行病学特征

正确答案：D。有阶段性

解析：传染病具有下列四个基本特征：（一）病原体（A对）；（二）传染性（B对）；（三）感染后免疫（C对）；（四）流行病学特征（E对）。综上，传染病的基本特征不包括有阶段性（D错，为本题正确答案）。